不属于新药临床前研究内容的是
A. 药效学研究
B. 一般药理学研究
C. 动物药动学研究
D. 毒理学研究
E. 人体安全性评价研究

正确答案：E。人体安全性评价研究

解析：本题考查新药临床前研究内容。不属于新药临床前研究内容的是人体安全性评价研究（E错，为本题正确答案）。临床前药理毒理学研究主要包括药效学研究（A对）、一般药理学研究（B对）、药动学研究（C对）、毒理学研究（D对）。